咳嗽变异型哮喘正确诊断的依据是
A. 咳嗽反复发作＞2周
B. 抗生素治疗有效
C. 支气管扩张剂能缓解
D. 无家族过敏史
E. 中性粒细胞增高

正确答案：C。支气管扩张剂能缓解

解析：由咳嗽变异型哮喘诊断标准可知：咳嗽应持续＞4周（A错），经长时间抗生素治疗无效（B错），支气管激发试验阳性即支气管扩张剂能缓解（C对），有家族过敏史（D错），而中性粒细胞增高（E错）不是咳嗽变异性哮喘的诊断依据之一。